根据《药品经营质量管理规范》，对新建药品零售和零售连锁企业的首营企业和首营品种，应进行下列哪种审核
A. 合法资格和药品价格
B. 合法票据和药品价格
C. 合法资格和药品包装
D. 合法资格和药品质量
E. 合法票据和药品质量

正确答案：D。合法资格和药品质量

解析：本题考察药品经营管理。对新建药品零售和零售连锁企业的首营企业和首营品种，应进行合法资格和药品质量（D对）审核。